除另有规定外，应进行软化点检查的是
A. 橡胶贴
B. 凝胶贴
C. 膏药
D. 贴剂
E. 软膏剂

正确答案：C。膏药

解析：本题考查的是膏药的质量要求。除另有规定外，应进行软化点检查的是膏药（C对）。膏药：系指饮片、食用植物油与红丹（铅丹）或官粉（铅粉）炼制成膏料，摊涂于裱褙材料上制成供皮肤贴敷的外用制剂。除另有规定外，膏药应密闭，置阴凉处贮存。膏药软化点、重量差异等应符合《中国药典》规定。橡胶贴（A错）与凝胶贴（B错）均属于贴膏剂。贴膏剂：系指将原料药物与适宜的基质制成膏状物涂布于背衬材料上供皮肤贴敷、可产生全身性或局部作用的一种薄片状制剂。按基质组成可分为以橡胶为主要基质的橡胶贴膏和以亲水性高分子材料为基质的凝胶贴膏。贴膏剂的含膏量、黏附力、微生物限度等应符合要求。橡胶贴膏还应检查耐热性；凝胶贴膏还应检查赋形性、含量均匀度。贴剂（D错）：系指原料药物与适宜的材料制成的供粘贴在皮肤上的可产生全身性或局部作用的一种薄片状制剂。贴剂根据需要也可加入表面活性剂、乳化剂、保湿剂、抑菌剂、抗氧剂或透皮促进剂。黏贴层涂布应均匀，用有机溶剂涂布的贴剂，应对残留溶剂进行检查。采用乙醇等溶剂应在标签中注明过敏者慎用。贴剂在标签中应注明每贴所含药物剂量、总的作用时间及药物释放的有效面积。除另有规定外，贴剂应密封贮存。贴剂的含量均匀度、释放度、微生物限度等照《中国药典》规定的检查方法检查，应符合规定。软膏剂（E错）：系指原料药物与油脂性或水溶性基质混合制成的均匀的半固体外用制剂。软膏剂应根检查：粒度、装量、无菌、微生物限度等。